脓液恶臭，普通细菌培养阴性的是
A. 大肠杆菌
B. 拟杆菌
C. 绿脓杆菌
D. 溶血性链球菌
E. 金黄色葡萄球菌

正确答案：B。拟杆菌

解析：拟杆菌（B对）感染的特点是脓液有特殊的恶臭，其不能单独培养，必须与利用氢的产甲烷细菌或硫酸盐还原菌共同培养，普通细菌培养阴性。大肠杆菌（A错）感染的特点是脓液稠厚、有臭味；绿脓杆菌（C错）感染脓液的特点为淡绿色，有特殊的甜腥臭味；溶血性链球菌（D错）感染特点是脓液稀薄、淡红色；金黄色葡萄球菌（E错）感染的特点是脓液稠厚、黄色、无臭味，以上细菌普通培养均为阳性。